对女性生殖器尖锐湿疣，不适宜的治疗是
A. 局部用三氯醋酸
B. 冷冻
C. 微波
D. 口服红霉素
E. 激光

正确答案：D。口服红霉素

解析：尖锐湿疣是由人乳头瘤病毒（HPV）感染引起的鳞状上皮疣状增生的病变，应使用抗病毒治疗。而红霉素（D错，为本题正确答案）属于大环内酯类抗生素，对由HPV病毒感染导致的尖锐湿疣无效。三氯醋酸（A对）是一种强酸，可以灼烧疣体，若外阴病灶较小，可用80%～90%三氯醋酸涂擦病变部位。若病灶大且有蒂，可行物理治疗，如激光（E对）、微波（C对）、冷冻（B对）、电灼等。